对两组有限量测量数据的平均值间进行显著差异检验，可采用
A. T检验
B. F检验
C. G检验
D. 4d法
E. 相关系数检验

正确答案：A。T检验